外源化学物的概念
A. 存在于人类生活和外界环境中
B. 与人类接触并进入机体
C. 具有生物活性，并有损害作用
D. 以上都是

正确答案：D。以上都是

解析：本题考查外源化学物。外源化学物是指存在于人类环境中、可能与机体接触并进入机体，在体内呈现一定的生物学效应的一些化学物质（D对ABC错）。